下列选项中属于问题设计的常见错误中的“双重装填”的是
A. 你是否得过两种慢性病
B. 你是否锻炼身体
C. 你是否具有“A型性格”
D. 你是否抽烟喝酒
E. 你上楼时是否胸闷

正确答案：D。你是否抽烟喝酒

解析：本题考查双重装填。双重装填是指一个问题中包括了两个或两个以上的问题，导致有些被调查者可能难以作出回答，如“你是否抽烟喝酒”（D对ABCE错）。